某女，42岁。反复咳嗽3年余，刻下咳嗽，痰多黏稠，时而色白，时而微黄，胸脘满闷；苔白腻，脉弦滑。诊断为咳嗽，证属痰气阻肺、肺失宣降。宜选用的中成药是
A. 清肺化痰丸
B. 复方鲜竹沥液
C. 百合固金丸
D. 橘贝半夏颗粒
E. 二母宁嗽丸

正确答案：D。橘贝半夏颗粒

解析：本题考查的是咳嗽的辨证论治。反复咳嗽3年余，刻下咳嗽，痰多黏稠，时而色白，时而微黄，胸脘满闷；苔白腻，脉弦滑。诊断为咳嗽，证属痰气阻肺、肺失宣降。宜选用的中成药是橘贝半夏颗粒（D对）。咳嗽是指肺失宣降，肺气上逆作声，或伴咳吐痰液，为肺系疾病的主要表现之一。（一）风寒袭肺证：【中成药应用】常用中成药有通宣理肺丸、风寒咳嗽丸、杏苏止咳糖浆、三拗片。（二）风热犯肺证：【中成药应用】常用中成药有桑菊感冒片、急支糖浆、羚羊清肺颗粒、风热咳嗽胶囊。（三）风燥伤肺证：【中成药应用】常用中成药有蜜炼川贝枇杷膏、二母宁嗽丸（E错）、雪梨止咳糖浆。（四）痰湿蕴肺证：【中成药应用】常用中成药有二陈丸、橘贝半夏颗粒、蛇胆陈皮胶囊。（五）痰热郁肺证：【中成药应用】常用中成药有清肺化痰丸（A错）、清肺抑火丸、复方鲜竹沥液（B错）。（六）肺阴亏耗证：【中成药应用】常用中成药有养阴清肺膏、百合固金丸（C错）、二冬膏。